下列论述哪一项是错误的
A. 咀嚼力是咀嚼肌所能发挥的最大力
B. 力量的大小，视参与咀嚼的肌纤维的多少而定
C. 成年人颞肌的横断面积约8cm2
D. 咬肌的横断面约4.5cm2
E. 翼内肌的横断面约4cm2

正确答案：D。咬肌的横断面约4.5cm2

解析：咀嚼肌力：是指参与咀嚼的肌肉所能发挥的最大力量，也称咀嚼力。力量的大小，视参与咀嚼的肌纤维的多少而定。一般以肌肉在生理状态下的横断面积的大小来衡量。就下颌提肌而论，成年人颞肌的横断面积约8cm2，咬肌的横断面约7.5cm2，翼内肌的横断面约4cm2，共19.5cm2。按照生理学测定法，每cm2具有10kg的力量，则三肌的合力应为195kg。根据肌纤维附着部位与其方向的不同，它们所产生的垂直向力为：颞肌80kg，咬肌70kg，翼内肌30kg，三肌的合力为180kg。掌握“咀嚼过程、类型，咀嚼周期及生物力”知识点。